翼外肌功能亢进治疗首选
A. 关节镜治疗
B. 泼尼松龙混悬液+2%利多卡因关节腔注射
C. 复位牙合板治疗
D. 0.5%或1%利多卡因局部封闭
E. 2%利多卡因关节腔内注射后手法复位

正确答案：D。0.5%或1%利多卡因局部封闭

解析：本题考查翼外肌功能亢进治疗方法。翼外肌功能亢进：是指在最大开口位时，翼外肌下头继续收缩，把髁突连同关节盘过度地强拉过关节结节发生大开口末弹响乃至关节半脱位的状况。治疗可用0.5%或1%利多卡因5mL作翼外肌封闭（D对），每日或每2～3日1次，5次为1个疗程。2%利多卡因关节腔内注射后手法复位（E错）适用于不可复性关节盘移位伴张口受限，但时间较短者可使用。